可用作药物固体分散体水溶性载体材料的是
A. 聚丙烯树脂Ⅲ号
B. 乙基纤维素
C. 醋酸纤维素酞酸酯
D. 聚丙烯树脂Ⅱ号
E. 聚乙烯吡咯烷酮

正确答案：E。聚乙烯吡咯烷酮

解析：本题考查的是固体分散体常用载体。可用作药物固体分散体水溶性载体材料的是聚乙烯吡咯烷酮（E对）。聚乙烯吡咯烷酮为聚维酮类的别名。固体分散体常用载体与应用：（1）水溶性载体材料：常用的有高分子聚合物（如聚乙二醇类、聚维酮类）、表面活性剂（如泊洛沙姆188、磷脂）、有机酸（如枸橼酸、酒石酸）、糖类（如山梨醇、蔗糖）、脲类（如尿素）等。这类载体材料水溶性大，作为固体分散体的载体材料，可增加难溶性药物溶出速度，提高其生物利用度。（2）难溶性载体材料：常用的有纤维素衍生物（如乙基纤维素（B错））、聚丙烯酸树脂类、脂类（如胆固醇、β-谷甾醇）等。这类载体材料难溶于水，常被作为缓释、控释型固体分散体的载体。（3）肠溶性载体材料：常用的有纤维素衍生物（如醋酸纤维素酞酸酯（C错））、聚丙烯树脂类（如聚丙烯树脂Ⅱ号（D错）、Ⅲ号（A错））等。这类载体材料在胃内强酸条件下不溶解，不受消化酶破坏，在体液中可溶胀。在小肠液、弱酸或碱性条件下可溶，常用来制备肠溶型固体分散体。